有一名4岁的儿童因臂骨折入院治疗，并当天进行手术。手术后的第3天发生麻疹。这种情况属于
A. 交叉感染
B. 合并感染
C. 手术后应激性反应
D. 医院性感染
E. 都不是

正确答案：E。都不是